葡萄糖的特殊杂质检查项目有
A. 亚硫酸盐和可溶性淀粉
B. 有关物质
C. 蛋白质
D. 乙醇溶液的澄清度
E. 钙盐

正确答案：A、C、D。亚硫酸盐和可溶性淀粉；蛋白质；乙醇溶液的澄清度